治疗缺铁性贫血首选
A. 维生素B₁₂
B. 铁剂
C. 促红细胞生成素
D. 丙酸睾酮
E. 肾上腺皮质激素

正确答案：B。铁剂

解析：缺铁性贫血治疗原则是根除病因，补足贮铁。用西药铁剂治疗有肯定的疗效，但副作用较多，配合中药可减轻或消除铁剂的副作用；对于不能服用铁剂的患者，可肌注铁剂，中医可以健脾和胃、益气养血或温补脾肾为法，谨防劫阴耗液，酌加含铁较高的中药（B对）。维生素B12可进行辅助治疗不做首选（A错）。促红细胞生成素、丙酸睾酮、肾上腺皮质激素不能有效改善机体缺铁情况一般不作为治疗缺铁性贫血方法（C、D、E错）。